有关淋巴管的叙述,不正确的是
A. 由毛细淋巴管汇集而成
B. 管壁由内、中、外三层构成，近似小静脉的管壁结构
C. 管腔内有比静脉瓣更多的瓣膜，以防止淋巴逆流
D. 不分浅、深淋巴管
E. 淋巴管间存在广泛的吻合和交通

正确答案：D。不分浅、深淋巴管

解析：淋巴管由毛细淋巴管汇集而成(A对），淋巴管分为浅淋巴管和深淋巴管（D错，为本题正确答案），深浅淋巴管间存在广泛的吻合和交通（E对），管壁由内、中、外三层构成，近似小静脉的管壁结构（B对），但管腔内有比静脉瓣更多的瓣膜，目的是防止淋巴逆流（C对）。